下列属纯浆液腺的是
A. 味腺
B. 舌腭腺
C. 舌前腺
D. 舌后腺
E. 舌下腺

正确答案：A。味腺

解析：本题考查纯浆液腺。属于纯浆液腺的是腮腺和味腺（A对）；属于纯黏液腺的包括舌腭腺（B错）、腭腺、舌后腺（D错）；属于混合腺的包括下颌下腺、舌下腺（E错）、唇腺、颊腺、磨牙后腺、舌前腺（C错）。